患者胸闷气短，甚则胸痛彻背，心悸汗岀，腰酸乏力，畏寒肢冷，唇甲淡白，舌淡白，脉沉微欲绝。治疗应首选
A. 人参养荣汤合左归饮
B. 炙甘草汤合生脉散
C. 参附汤合右归饮
D. 苓桂术甘汤合左归丸
E. 苏合香丸合左归饮

正确答案：C。参附汤合右归饮

解析：胸闷气短，甚则胸痛彻背可判断为急性心肌梗死，属于中医“胸痹”的范畴。阳气虚衰，胸阳不运，气机痹阻，血行瘀滞，故见胸闷气短，甚则胸痛彻背；心阳不振则心悸汗出；肾阳虚衰则腰酸乏力，畏寒肢冷；脉沉微欲绝为心肾阳虚之侯，因此诊断为心肾阳虚证。当治以益气壮阳，温络止痛，用参附汤合右归饮治疗（C对）。人参养荣汤合左归饮（A错）可以益气养阴，通络止痛。炙甘草汤合生脉散（B错）可以益气养阴，活血通络，用于治疗气阴两虚证。苓桂术甘汤合左归丸（D错）可以温阳利水，滋补肾阴。苏合香丸合左归饮（E错）可以芳香温通，滋补肾阴。